心悸心虚胆怯证的特点是
A. 心悸烦躁，善惊痰多
B. 心悸善惊，坐卧不安
C. 惊悸眩晕，胸闷喘憋
D. 心悸怵惕，心痛胸闷
E. 虚烦而悸，耳鸣腰痠

正确答案：B。心悸善惊，坐卧不安

解析：惊则气乱，心神不能自主，故发为心悸；心不藏神，心中惕惕，则善惊，坐卧不安（B对）。心悸烦躁，善惊痰多，属于心悸之痰火扰心证的特点（A错）。惊悸眩晕，胸闷喘憋，属于心悸之水饮凌心证的特点（C错）。心悸怵惕，心痛胸闷，属于心悸之心血瘀阻证的特点（D错）。虚烦而悸，耳鸣腰痠，属于心悸之阴虚火旺证的特点（E错）。